流感嗜血杆菌不能引起
A. 流感
B. 支气管炎
C. 化脓性脑膜炎
D. 咽喉会厌炎
E. 化脓性关节炎

正确答案：A。流感

解析：流感嗜血杆菌俗称流感杆菌，是嗜血杆菌属中对人有致病性的最常见细菌。其只是在流感时继发感染的常见细菌。其所致疾病分为两种：原发性感染（外源性）多由荚膜引起的急性化脓性感染，如化脓性脑膜炎、咽喉会咽炎、化脓性关节炎、心包炎等。继发性感染（内源性）多由呼吸道寄居的无荚膜菌株引起，如慢性支气管炎、鼻窦炎中耳炎等。掌握“流感、百日咳及幽门螺杆菌”知识点。